给消费者、病人、医务人员提供正确、合适的药品或与药品有关的信息，是
A. 执业药师的执业行为规范
B. 执业药师的道德准则
C. 执业药师的责任
D. 执业药师的权力
E. 执业药师的义务

正确答案：C。执业药师的责任